产后腹痛血瘀证的治法是
A. 养血活血
B. 补血益气
C. 行气养血
D. 活血止痛
E. 活血化瘀，散寒止痛

正确答案：E。活血化瘀，散寒止痛

解析：产后腹痛瘀滞子宫，应活血化瘀，温经止痛。血得热则畅行，凝滞稍通，得热痛减，活血化瘀，使血块排出瘀滞缓解，令腹痛暂缓（E对）。养血活血多用于血少血瘀证（A错）。补血益气多用于气血两虚证（B错）。行气养血多用于气滞血少证（C错）。活血止痛可用于瘀血阻滞的病症（D错）。